对临床疑诊自发性气胸病人，应首选的检查方法是
A. B型超声波
B. 胸部CT
C. 胸部X线
D. 磁共振成象
E. 纤维支气管镜

正确答案：C。胸部X线

解析：胸部X线片是诊断气胸的重要方法，可显示肺受压程度，肺内病变情况等，故临床上对疑诊自发性气胸病人，应首选的检查方法是胸部X线（C对），胸部CT（B错）也是诊断气胸的方法，发现小量气胸、局限性气胸较胸部X线更敏感和准确，但不作为诊断气胸的首选的检查方法。超声波（A错）是腹部脏器病变如肝、脾、胰腺等的首选检查。磁共振成像（D错）是鼻咽部、喉部的良、恶性病变、肝、胆、胰、脾肿瘤和先天性发育异常、肝寄生虫病、弥漫性肝病及神经系统的病变等的首选和确诊方法。纤维支气管镜（E错）适用于作肺叶、段及亚段支气管病变的观察，活检采样，细菌学、细胞学检查，能发现早期病变，对支气管、肺疾病如支气管结核、支气管异物、肺不张、肺结核、肺部肿等的诊断和治疗有重要意义。